微核试验可用于检测
A. DNA加合物
B. 引起核粉碎的遗传毒物
C. 断裂剂和非整倍体剂
D. 引起碱基置换的遗传毒物
E. 引起移码突变的遗传毒物

正确答案：C。断裂剂和非整倍体剂